引起痛痛病的污染物是
A. 汞
B. 铬
C. 有机磷农药
D. 镉
E. 铊

正确答案：D。镉

解析：本题考查引起痛痛病的污染物。痛痛病是发生在日本富山县神通川流域部分镉污染地区的一种严重的环境污染性疾病，以全身剧烈疼痛为主要症状而得名，是慢性镉中毒的典型案例。主要原因是当地居民长期饮用受镉污染（D对ABCE错）的河水，并食用此水灌溉的含镉稻米，致使镉在体内蓄积，发生慢性镉中毒，导致了痛痛病的发生。